对明确直肠癌局部浸润状况最有意义的检查是
A. 结肠镜
B. 全消化道X线钡餐造影
C. 结肠X线钡剂造影
D. 腹部B超
E. 盆腹部增强CT

正确答案：E。盆腹部增强CT

解析：直肠癌常用的检查方法有大便潜血检查、直肠指诊、内镜检查、影像学检查、肿瘤标记物检查等。盆腹部增强CT（E对）可以了解直肠癌盆腔内扩散情况，有无侵犯膀胱、子宫及盆壁，对明确直肠癌局部浸润有意义。结肠镜（A错）是门诊常规检查，一般用于直肠癌筛查及在内镜直视下取组织行病理检查。全消化道X线钡餐造影（B错）和结肠X线钡剂造影（C错）对了解直肠癌局部浸润意义不大，可以用来排除结、直肠多发癌和息肉病。腹部B超（D错）多用于检查有无肝转移。